慢性支气管炎患者呼吸道感染时，最常致病的革兰阴性杆菌为
A. 肺炎克雷伯杆菌
B. 流感嗜血杆菌
C. 大肠杆菌
D. 变形杆菌
E. 绿脓杆菌

正确答案：B。流感嗜血杆菌

解析：慢性支气管炎患者呼吸道感染，常见病原体为肺炎链球菌、流感嗜血杆菌、卡他莫拉菌和葡萄球菌等（ACDE错），其中流感嗜血杆菌为革兰阴性杆菌（B对），卡他莫拉菌为革兰阴性球菌，而肺炎链球菌和葡萄球菌为革兰阳性球菌。